子宫附件指的是
A. 阴道
B. 卵巢
C. 输卵管
D. 输卵管和卵巢
E. 输卵管和阴道

正确答案：D。输卵管和卵巢

解析：输卵管和卵巢（D对）二者合称子宫附件。